中医精气神学说中的“神”的含义是指
A. 人体生命活动的主宰
B. 人的精神意识
C. 人体生命的基本物质
D. 人体生命活动的动力
E. 以上都不是

正确答案：A。人体生命活动的主宰

解析：人体之神有广义、狭义之分，广义之神，指人体生命活动的主宰及其外在总体表现的统称，包括形色、眼神、言谈、表情、应答、举止、精神、情志、声息、脉象等方面；狭义之神，指意识、思维、情志等精神活动（A对）。人的精神意识只有在神的统帅和调节下，才能发挥正常作用（B错）。中医认为气是生命的本原，是构成生命的基本物质（C错）。气的运动推动着宇宙万物的发生发展和变化（DE错）。